HLA复合体位于第6号染色体短臂，全长为
A. 2600kb
B. 3600kb
C. 4600kb
D. 5600kb
E. 6600kb

正确答案：B。3600kb

解析：HLA复合体的定位和结构：HLA复合体位于第6号染色体短臂，全长3600kb。掌握“HLA种类及其产物、医学意义”知识点。